下列疾病中适宜开展二级预防的是
A. 麻疹
B. 色盲
C. 胰腺癌
D. 肺结核
E. 心肌梗死

正确答案：D。肺结核

解析：本题考查二级预防。第二级预防又称“三早”预防，即早发现、早诊断、早治疗。第二级预防是在疾病早期，症状体征尚未表现出来或难以觉察，通过及早发现并诊断疾病，及时给予适当的治疗，有更大的机会实现治愈。疾病的早发现可通过筛检、病例发现、定期体检等实现。如肺结核（D对ABCE错）可通过影像学检查、痰结核菌素检查、血清学检查进行筛检。